发热而赤，汗出口渴，面赤心烦，舌红，脉洪大，宜用方剂
A. 竹叶石膏汤
B. 犀角地黄汤
C. 白虎汤
D. 清营汤
E. 银翘散

正确答案：C。白虎汤

解析：“发热而赤，面赤心烦”提示里热炽盛；“汗出口渴”乃里热蒸腾，迫津外泄，汗出津耗的表现；“舌红，脉洪大”热盛于经所致。故本证为伤寒化热内传阳明之经，或温邪由卫及气的气分热盛证。应清热生津，当为白虎汤（C对）--重用石膏为君，清阳明气分大热；臣以知母，止渴除烦；粳米、炙甘草益胃生津，缓石膏、知母苦寒重降之性，为佐药；炙甘草兼以调和诸药为使。竹叶石膏汤功用为清热生津，益气和胃，主治伤寒、温病、暑病余热未清（A错）。犀角地黄汤功用为清热解毒，凉血散瘀，主治热入血分证（B错）。清营汤功用为清营解毒，透热养阴，主治热入营分证（D错）。银翘散功用为辛凉透表，清热解毒，主治温病初起（E错）。